患者女性30岁，于拔除过程中因疼痛紧张，而出现胸闷、心慌、面色苍白、四肢湿冷、脉快而弱，此情况属于
A. 肾上腺素反应
B. 麻药中毒
C. 癔病
D. 麻药过敏
E. 晕厥

正确答案：E。晕厥

解析：本题考查局麻的并发症。晕厥（E对）是拔牙患者局麻时会发生的一种一时性中枢缺血导致的突发性、暂时性意识丧失。该患者出现胸闷、心慌、面色苍白、四肢湿冷、脉快而弱，都是晕厥的前驱症状，一般因疼痛、紧张、恐惧、饥饿、疲劳、全身健康状况较差以及体位不良导致；完全符合该患者的情况。肾上腺素反应（A错）常见症状为头晕、头痛、口唇苍白、血压上升、脉搏快而有力，而该患者脉快而弱。麻药中毒（B错）分为兴奋型与抑制型，兴奋型表现为烦躁不安、多话颤抖、恶心呕吐、气急多汗、血压升高、全身抽搐和缺氧发绀；抑制性表现为脉搏细弱、血压下降、神志不清、呼吸心跳骤停。癔病（C错）是一种患者自我暗示，使身体觉得自己患有某种疾病而产生相应的临床症状，但组织器官无器质性病变，题干并未提及患者有任何精神异常。麻药过敏（D错）分为延迟反应和即刻反应，延迟反应常是血管神经性水肿；即刻反应是用极少量药后，立即发生的类似中毒症状，表现为惊厥、昏迷、呼吸心搏骤停而死亡，该患者并未表现出上述症状。